具有约束纵行诸经功能的是
A. 带脉
B. 督脉
C. 阴阳维脉
D. 冲脉
E. 任脉

正确答案：A。带脉

解析：带脉功能：①约束纵行诸经。②主司妇女带下（A对）。督脉功能：①调节阳经气血，为“阳脉之海”。②反映脑、髓和肾的功能（B错）。任脉功能：①调节阴经气血，为“阴脉之海”。②任主胞胎（E错）。冲脉功能：①调节十二经脉气血。②与女子月经及生殖功能有关（D错）。阴阳维脉功能：阴维脉“维络诸阴”阳维脉“维络诸阳”。阴维脉与足三阴经相交会，最后合于任脉，阳维脉与手足阳经相交，最后合于督脉。阴阳相辅，对诸阴阳经脉气血起着溢蓄调节作用（C错）。奇经八脉功能为高频考点，需考生准确记忆。